在含量均匀度检查的判断公式中，以下字母的含义为:S
A. 平均片重
B. 每片以标示量为100的相对含量
C. 相对含量的标准差
D. 标示量（以100计）与相对含量均值之差的绝对值
E. 相关系数

正确答案：C。相对含量的标准差